女，55岁。因右上67缺失,行右上4567固定义齿修复，一年后基牙有咬合痛，松动。其主要原因为
A. 设计不合理
B. 固位力不够
C. 基牙数目少
D. 末端侧下沉
E. 咬合早接触

正确答案：A。设计不合理

解析：本题考查固定义齿修复可能出现的问题及原因。此患者右上67缺失,行右上4567固定义齿修复，此为单端固定桥设计。后牙末端游离缺失的患者，用单端固定桥修复，桥体受力，产生的杠杆作用大，容易造成基牙牙周组织损伤如疼痛、松动等。76缺失，如果8的条件差或缺失，均不宜设计固定桥修复。即使8能够作基牙，458为基牙修复67的固定桥在支持和固位方面仍达不到要求，不宜采用，因此基牙咬合痛，松动的主要原因为设计不合理（A对）。固位力不够（B错）、基牙数目少（C错）、末端侧下沉（D错）、咬合早接触（E错）也可能造成基牙疼痛、松动，但此患者基牙松动的最根本原因还是设计不合理。